组成药物中不含黄连的方剂是
A. 枳实导滞丸
B. 普济消毒饮
C. 龙胆泻肝汤
D. 芍药汤
E. 清营汤

正确答案：C。龙胆泻肝汤

解析：本题考查方剂的组成，属于记忆内容。龙胆泻肝汤功用清泻肝胆实火，清利肝经湿热，由龙胆草、黄芩、栀子、泽泻、木桶 当归、生地黄、柴胡、生甘草、车前子组成，不含黄连（C对）。枳实导滞丸功用消导化积，清热利湿，由大黄、枳实、神曲、茯苓、黄芩、黄连、白术、泽泻组成，含有黄连（A错）。普济消毒饮功用清热解毒，由黄芩、黄连、陈皮、甘草、玄参、柴胡、桔梗、连翘、板蓝根、马勃、牛蒡子、薄荷、僵蚕、升麻组成，含有黄连（B错）。芍药汤功用清热燥湿，调气和血，由芍药、当归、黄连、槟榔、木香 甘草、大黄、黄芩、官桂组成，含有黄连（D错）。清营汤功用清营解毒，透热养阴，由犀角、生地黄、元参、竹叶、麦冬、丹参、黄连 银花、连翘组成，含有黄连（E错）。记忆：龙胆泻肝汤，龙胆栀芩酒伴炒，木桶泽泻车柴草，当归生地益阴血，肝胆实火湿热消